一健康儿童体检结果为：身高115cm。体重20kg，尚未开始换牙，腕部骨化中心数为7个，按照小儿生长发育的一般规律，其最可能的年龄是
A. 6岁
B. 8岁
C. 4岁
D. 5岁
E. 7岁

正确答案：A。6岁

解析：根据体重估计公式，1～12岁体重＝年龄（岁）×2+8，本例儿童体重20kg，算出年龄为6岁。根据身高估计公式，2～12岁身高＝年龄（岁）×7+75，本例儿童身高115cm，计算得出5.71，取整数，算出年龄6岁。1～９岁腕部骨化中心的数目大约为其岁数加1，本例儿童腕部骨化中心数为7，判断年龄为6岁。6～12岁阶段乳牙逐个被同位恒牙替换，本例儿童尚未开始换牙。综合判断最可能年龄是6岁（A对）。